肾上腺叙述错误的是
A. 质软，淡黄色
B. 左侧肾上腺似半月形
C. 右侧呈三角形
D. 位于肾上方偏内侧
E. 包裹于肾纤维囊内

正确答案：E。包裹于肾纤维囊内

解析：肾上腺位于肾的上方偏内侧（D对）, 质软，淡黄色（A对），与肾共同包裹于肾筋膜内（E错，为本题正确答案）。左侧肾上腺似半月形（B对），右侧肾上腺呈三角形（C对）。